对恒牙萌出的正确描述是
A. 上颌牙萌出顺序1-2-3-4-5-6-7
B. 上颌牙萌出顺序1-2-4-5-3-6-7
C. 上颌牙萌出顺序6-1-2-3-4-5-7
D. 下颌牙萌出顺序6-1-2-3-4-5-7
E. 下颌牙萌出顺序6-1-2-4-5-3-7

正确答案：D。下颌牙萌出顺序6-1-2-3-4-5-7

解析：本题考查恒牙的萌出顺序。对恒牙萌出的正确描述是下颌牙萌出顺序6-1-2-3-4-5-7（D对）。第一磨牙（6）是最早萌出的恒牙，大约6岁左右萌出，又称六龄齿。恒牙萌出顺序有一定的规律，上颌多为6-1-2-4-3-5-7或6-1-2-4-5-3-7（ABC错），下颌多为6-1-2-3-4-5-7或6-1-2-4-3-5-7（E错）。恒牙萌出顺序异常易导致错（牙合）畸形。第一恒磨牙形成于胚胎第4个月，是恒牙中最早形成的牙胚；恒切牙及尖牙的牙胚形成于胚胎第5～6个月；前磨牙牙胚形成于胚胎第10个月；第二恒磨牙牙胚在出生后1岁时形成，而第三磨牙牙胚形成于出生后4～5岁